比较某地区15岁儿童平均体重是否高于一般，宜采用
A. u检验
B. t检验
C. F检验
D. χ2检验
E. 以上都不是

正确答案：B。t检验